药师面向护士的用药咨询内容包括
A. 药物的适宜溶剂
B. 药物的稀释容积
C. 药物滴注速度
D. 药物的配伍禁忌
E. 替代治疗方案

正确答案：A、B、C、D。药物的适宜溶剂；药物的稀释容积；药物滴注速度；药物的配伍禁忌

解析：本题考查用药咨询。药师面向护士的用药咨询内容包括：药物的适宜溶剂（A对）、药物的稀释容积（B对）、药物的滴注速度（C对）、药物的配伍禁忌（D对）和药品辅料、包材、用药装置方面的咨询。替代治疗方案（E错）是患者向药师咨询的内容。